糖酵解途径的关键酶是
A. 乳酸脱氢酶
B. 果糖双磷酸酶
C. 6-磷酸果糖激酶-1
D. 6-磷酸果糖激酶-2
E. 3-磷酸甘油醛脱氢酶

正确答案：C。6-磷酸果糖激酶-1

解析：糖酵解途径的关键酶：己糖激酶（或葡萄糖激酶），6-磷酸果糖激酶-1和丙酮酸激酶。这三种酶是糖酵解途径的限速酶，其活性可受别构效应剂和激素的调节。限速酶活性的高低决定着糖酵解的速度和方向。掌握“糖分解”知识点。